属于类脂类的软膏基质是
A. 卡波姆
B. 羊毛脂
C. 凡士林
D. 硅油
E. 聚乙二醇

正确答案：B。羊毛脂